苯胺可经过多种途径进入人体，其中经（）吸收是引起工业中毒的主要原因
A. 呼吸道
B. 消化道
C. 皮肤
D. 皮肤附属组织

正确答案：C。皮肤

解析：本题考查苯胺的吸收途径。苯胺可经呼吸道、皮肤和消化道进入人体，经皮（C对ABD错）吸收是引起中毒的主要原因。其液态及其蒸气都可经皮吸收，吸收率随室温和相对湿度的升高而增加。